初产妇，28岁。妊娠41周，产程进展过程中因潜伏期过长行人工破膜术，宫口扩张2cm，胎头位于坐骨棘水平上2cm，羊水Ⅲ度混浊，量5mL，胎心率150次/分。应首选的处理措施是
A. 观察
B. 吸氧
C. 立即剖宫产
D. 注射哌替啶
E. 静滴催产素

正确答案：C。立即剖宫产

解析：患者孕周41周，出现羊水Ⅲ度混浊，量5mL，孕周越大，羊水胎粪污染的概率就会越高，一些高危因素也会增加胎粪排出的概率，比如妊娠期肝内胆汁淤积综合征，容易造成胎儿窘迫，故首选立即剖宫产（C对）。